女性，56岁，右下颌下颈部肿痛5天，伴发热39℃，无寒战，难平卧。诊为急性蜂窝织炎，其最危险的后果是
A. 扩散至面部
B. 扩散至上纵隔
C. 扩散为脓毒症
D. 引发吞咽困难、呕吐
E. 引起呼吸困难、窒息

正确答案：E。引起呼吸困难、窒息

解析：因颈部解剖结构复杂，是头与胸、腹的枢纽，如发生急性化脓性感染，病情均十分严重，最危险的是炎症或脓肿形成，颈内压力增高、压迫气管。该患者不能平卧，说明气管已有受压，再加重极易引起呼吸困难、窒息，危及生命。掌握“软组织急性感染”知识点。